以下哪项疾病的特点是一组含多核巨细胞的颌骨病变，多数为非肿瘤性、修复性疾病，单纯刮治即可治愈，很少复发
A. 嗜酸性肉芽肿
B. 骨巨细胞瘤
C. 汉-许-克病
D. 巨细胞肉芽肿
E. 勒-雪病

正确答案：D。巨细胞肉芽肿

解析：巨细胞肉芽肿过去曾被称为巨细胞修复性肉芽肿，是指一组含多核巨细胞的颌骨病变，多数为非肿瘤性、修复性疾病，发展缓慢，不穿破骨皮质，单纯刮治即可治愈，很少复发。掌握“颌骨的非肿瘤性疾病”知识点。